提示存在消化道肿瘤的报警症状中，不包括
A. 黑便
B. 贫血
C. 消瘦
D. 吞咽困难
E. 喛气

正确答案：E。喛气

解析：消化道的肿瘤发生后，多会出现一些报警症状提示有消化道肿瘤的存在，包括肿瘤引起的局部表现及全身症状，包括黑便（A对）、吞咽困难（D对）等肿瘤引起的局部表现及贫血（B对）、消瘦（C对）等肿瘤引起的全身症状，而嗳气（E错，为本题正确答案）多出现在消化不良等疾病中，而不是消化道肿瘤的报警症状。